直肠上动脉起自
A. 回结肠
B. 右结肠动脉
C. 中结肠动脉
D. 左结肠动脉
E. 肠系膜下动脉

正确答案：E。肠系膜下动脉

解析：肠系膜下动脉（E对）分支有直肠上动脉、左结肠动脉和乙状结肠动脉。